以下关于眶下孔的叙述中哪项是错误的
A. 眶下孔位于眶下缘中点下方约0.5cm处
B. 眶下孔内有眶下神经、血管通过
C. 眶下孔朝向前内下方，行眶下神经阻滞麻醉时进针方向应为前内下
D. 眶下孔向后外上方通入眶下管
E. 眶下孔的下方骨面上有尖牙窝

正确答案：C。眶下孔朝向前内下方，行眶下神经阻滞麻醉时进针方向应为前内下

解析：眶下孔位于眶下缘中点下方约0.5cm处，孔内有眶下神经、血管通过，是眶下神经阻滞麻醉的有效注射部位，眶下孔向后、上、外方通入眶下管，尖牙窝一般位于前磨牙根尖的上方。掌握“上颌骨解剖特点”知识点。